十二指肠的哪一段位于腹主动脉与肠系膜上动脉所形成的夹角内
A. 上部
B. 降部
C. 水平部
D. 升部
E. 十二指肠球

正确答案：C。水平部

解析：十二指肠水平部经过腹主动脉前方且肠系膜上动脉紧贴水平部前面下行，所以水平部(C对)位于腹主动脉与肠系膜上动脉所形成的夹角内。